下颌左右5678缺失患者。如果剩余牙槽嵴丰满，左右下4牙槽骨吸收1/3。左右下4固位体宜采用
A. 三臂卡环
B. 隙卡
C. RPI卡环
D. 延伸卡环
E. 圈形卡环

正确答案：C。RPI卡环

解析：本题考查卡环的种类及适应证。可摘局部义齿有三种支持方式，包括牙支持式、黏膜支持式和混合支持式。当患者牙剩余牙槽嵴丰满，左右下4牙槽骨吸收1/3时，应尽量减轻基牙所受（牙合）力，将（牙合）力分散至黏膜及剩余牙槽骨上，保护基牙。RPI卡环（C对）通过其近中（牙合）支托、远中邻面板的作用，将支点从远中移至近中，对基牙无扭力作用，使基牙受力减少以保护基牙。三臂卡环（A错）由颊、舌两臂及支托组成，支托将义齿所承受的咀嚼压力传递到基牙上，加重基牙负荷，不可用。隙卡（B错）作为一种间接固位体，可防止义齿旋转，但没有分散（牙合）力的作用。延伸卡环（D错）对松动基牙有固定夹板作用，但没有分散（牙合）力的作用。圈形卡环（E错）多用于最后孤立磨牙的远中，起固位和稳定作用，但没有分担（牙合）力的作用。